咳血方与小蓟饮子中均含有的药物是
A. 山栀子
B. 青黛
C. 炙甘草
D. 生地
E. 滑石

正确答案：A。山栀子

解析：咳血方组成为青黛、瓜蒌、海粉、山栀子、诃子（咳血方中诃子收，瓜蒌海粉山栀投，青黛蜜丸口噙化，咳嗽痰血服之谬）；小蓟饮子组成为生地、小蓟、滑石、木通、蒲黄、藕节、淡竹叶、当归、山栀子、甘草（小蓟饮子藕蒲黄，木通滑石生地襄，归草黑栀淡竹叶，血淋热结服之良）（A对）。